男，50岁。近日出现尿频、排尿困难，直肠指检发现前列腺有结节，为进一步明确诊断，需采取的检查
A. 血清PSA
B. 前列腺穿刺活检
C. MRI
D. CT
E. B超

正确答案：B。前列腺穿刺活检